下列哪项不属于神经反射的深反射
A. 肱二头肌反射
B. 肱三头肌反射
C. 膝腱反射
D. 腹壁反射
E. 跟腱反射

正确答案：D。腹壁反射

解析：神经反射包括浅反射和深反射。深反射指刺激骨膜、肌腱经深部感受器完成的反射，包括肱二头肌反射（A对）、肱三头肌反射（B对）、膝腱反射（C对）、桡骨膜反射、跟腱反射（E对）及阵挛。浅反射指刺激皮肤、黏膜或角膜等引起的反射，腹壁反射（D错，为本题正确答案）、提睾反射、角膜反射、跖反射、肛门反射为浅反射。